属于时间依赖型药物的是
A. 环丙沙星
B. 阿奇霉素
C. 阿米卡星
D. 依替米星
E. 头孢哌酮

正确答案：E。头孢哌酮

解析：本题考查时间依赖型药物。头孢哌酮（E对）为头孢菌素类抗菌药物，是时间依赖型药物。环丙沙星（A错）是氟喹诺酮类抗菌药物，具有光敏反应。阿奇霉素（B错）、阿米卡星（C错）、依替米星（D错）均属于浓度依赖型抗菌药物。